五脏主五志，则忧属
A. 心
B. 肾
C. 肝
D. 肺
E. 脾

正确答案：D。肺

解析：五脏主五志，心在志为喜（A错）。肾在志为恐（B错）。肝在志为怒（C错）。肺在志为忧悲（D对）。脾在志为思（E错）。